抗原转换指的是
A. 变异幅度小，出现频率低
B. 变异幅度小，出现频率高
C. 变异幅度大，出现频率低
D. 变异幅度大，出现频率高
E. 发生于乙型

正确答案：C。变异幅度大，出现频率低

解析：抗原转换是指变异幅度较大，但变异发生频率较低，变异以后会产生新亚型（C对）。抗原漂移是由于基因组发生突变，导致抗原发生小幅度变异，但并不产生新亚型，属于亚型内变异，出现频率较高，且有累及效应，当达到一定程度后，可以引起中小型流感流行（B错）。抗原漂移是甲型流感病毒变异的主要形式（E错）。